先由参保人员自付一定比例，再按基本医疗保险的规定支付的是
A. 使用“甲类目录”药品所发生的费用
B. 使用“乙类目录”药品所发生的费用
C. 使用中药饮片所发生的费用
D. 使用口服泡腾剂所发生的费用
E. 使用中药材和中药饮片炮制的各类酒制剂所发生的费用

正确答案：B。使用“乙类目录”药品所发生的费用

解析：本题考查的是医保药品使用的费用支付原则。先由参保人员自付一定比例，再按基本医疗保险的规定支付的是使用“乙类目录”药品所发生的费用（B对）。医保药品使用的费用的支付方式：使用“甲类目录”的药品所发生的费用（A错），按基本医疗保险的规定支付。使用“乙类目录”的药品所发生的费用，先由参保人员自付一定比例，再按基本医疗保险的规定支付。个人自付的具体比例，由统筹地区规定，报省、自治区、直辖市医疗保障管理部门备案。